正常情况下不能通过肾小球滤过膜的物质是
A. Na⁺
B. 氨基酸
C. 甘露醇
D. 葡萄糖
E. 血浆清蛋白

正确答案：E。血浆清蛋白